药品注册管理办法适用范围不包括
A. 药品注册检验
B. 药品经营
C. 药品进口
D. 药品审批
E. 药物临床试验

正确答案：B。药品经营

解析：本题考查药品注册管理办法。药品注册管理办法适用范围不包括（B错，为本题正确答案）。《药品注册管理办法》第一章总则第二条：在中华人民共和国境内以药品上市为目的，从事药品研制（E对）、注册（ACD对）及监督管理活动，适用本办法。